对于一种严重的致死性疾病，在评价某种新的疗法的效果时，最恰当的指标是
A. 发病率
B. 患病率
C. 病死率
D. 死亡率
E. 罹患率

正确答案：C。病死率